苯巴比妥在90%的乙醇溶液中溶解度最大，90%的乙醇溶液可作为
A. 潜溶剂
B. 增溶剂
C. 絮凝剂
D. 消泡剂
E. 助溶剂

正确答案：A。潜溶剂

解析：本题考查液体制剂常用的附加剂。潜溶剂（A对）系指能形成氢键以增加难溶性药物溶解度的混合溶剂，乙醇能与水形成潜溶剂，以增加难溶性药物溶解度。苯巴比妥在90%的乙醇溶液中溶解度最大，此时90%的乙醇溶液为潜溶剂；常用的增溶剂（B错）为聚山梨酯类、聚氧乙烯脂肪酸酯类等；絮凝剂（C错）是指在混悬剂中加入的适宜的电解质，使微粒间的排斥力稍低于吸引力；消泡剂（D错）是可消除泡沫的物质；助溶剂（E错）多为某些有机酸及其盐类如苯甲酸、碘化钾等。